休克Ⅱ期组织微循环淤血缺氧的病理生理学基础是
A. γa/γv↑
B. γa/γv↓
C. A-V短路开放
D. 直接通路关闭
E. 直接通路开放

正确答案：B。γa/γv↓

解析：休克Ⅱ期组织微循环淤血缺氧因为微动脉、后微动脉和毛细血管前括约肌收缩性减弱甚至扩张，大量血液涌入真毛细血管网。微静脉虽也表现为扩张，但因血流缓慢，细胞嵌塞，使微循环流出道阻力增加，毛细血管后阻力大于前阻力而导致血液淤滞于微循环中，所以γa/γv ↓（B对ACDE错）。